治疗亚硝酸盐食物中毒的特效解毒药物是
A. 亚甲蓝
B. 二流基丙醇
C. 亚硝酸异戍酯
D. 硫代硫酸钠
E. 亚硝酸钠

正确答案：A。亚甲蓝